女性，45岁。右乳2.5cm×2.0cm肿块，活动度大。穿刺细胞学诊断为乳腺癌。右侧腋窝扪及多枚肿大质硬整合的淋巴结，锁骨上颈部未扪及淋巴结，检查未发现远处转移征象。该病人的临床分期是
A. T₁N₁M₀
B. T₂N₁M₀
C. T₂N₂M₀
D. T₂N₂M₁
E. T₁N₃M₀

正确答案：C。T₂N₂M₀

解析：右乳2.5cm×2.0cm肿块，活动度大（提示未侵及皮肤或胸壁），长径介于2cm～5cm之间，属于T2；右侧腋窝扪及多枚肿大、质硬、融合的淋巴结，锁骨上、颈部未扪及淋巴结，属于N2；检查未发现远处转移征象，属于M0。综上所述，该病人的临床分期是T2N2M0（C对）。